下述哪种方法不能增加药物的溶解度
A. 加入助溶剂
B. 加入非离子表面活性剂
C. 制成盐类
D. 应用潜溶剂
E. 加入助悬剂

正确答案：E。加入助悬剂

解析：本题考查增加药物溶解度的方法。加入助悬剂（E错，为本题正确答案）
提高混悬剂稳定性的方法。增加药物溶解度的方法：①加入增溶剂。具有增溶作用的表面活性剂称为增溶剂（B对）。②加入助溶剂（A对）。③制成盐类（C对）。④使用混合溶剂。在混合溶剂中各溶剂在某一比例中，药物的溶解度比在各单纯溶剂中的溶解度大，而且出现极大值，这种现象称为潜溶，这种溶剂称为潜溶剂（D对）。⑤制成共晶。此外，提高温度、改变pH可促进药物的溶解；应用微粉化技术可减小粒径，促进药物溶解；固体分散体、包合技术等新技术的应用也可促进药物的溶解。